男，36岁，病史2周，贫血伴周身出血点，浅表淋巴结不肿大，胸骨压痛（+），肝脏轻度肿大，外周血白细胞25×10⁹/L，可见幼稚细胞，血小板50×10⁹/L，血红蛋白40g/L。该患者最可能的诊断是
A. 急性白血病
B. 再生障碍性贫血
C. 过敏性紫癜
D. 败血症
E. 恶性淋巴瘤

正确答案：A。急性白血病

解析：男，36岁，病史2周（急性起病），贫血伴周身出血点（血小板下降导致凝血异常）；浅表淋巴结不肿大：胸骨压痛（+），肝脏轻度肿大（白细胞增殖浸润的表现）；血象外周血白细胞25×10⁹/L（﹥10×10⁹/L者称为白细胞增多性白血病），可见幼稚细胞，血小板50×10⁹/L（约50%的病人血小板<60x10⁹/L），血红蛋白40g/L（Hb在30-59g/L之间为重度贫血）。根据患者病史、临床表现和实验室检查可以诊断患者为急性白血病（A对）。再生障碍性贫血表现为贫血、出血、感染症状。网织红细胞绝对值﹤15x10 ⁹/L、中性粒细胞﹤0.5x10 ⁹/L、血小板﹤20x10 ⁹/L。骨髓增生广泛重度减低（B错）。过敏性紫癜是一种血管变态反应性疾病，主要由机体对某些致敏物质产生变态反应引起的。血小板计数、功能及凝血相关检查正常（C错）。败血症多由感染引起，白细胞、中性粒细胞百分比升高等相关感染指标升高（D错）。恶性淋巴瘤首发症状是无痛性颈部或锁骨上淋巴结进行性肿大（E错）。